致病力最强的人禽流感病毒亚型是
A. H₁N₁
B. H₃N₃
C. H₅N₁
D. H₇N₇
E. H₉N₂

正确答案：C。H₅N₁

解析：根据其致病性，禽流感病毒可分为高致病性、低致病性和非致病性三大类，其中H5和H7亚型为高致病型，又以H5N1致病性最强（C对）。